慢性根尖周炎反复发作后引起的牙周病变所具有的特点正确的是
A. 有深牙周袋
B. 牙槽骨吸收
C. 牙周袋溢脓
D. X线片表现为根尖区形成典型的“烧瓶形”或“日晕圈”状病变
E. 牙松动

正确答案：D。X线片表现为根尖区形成典型的“烧瓶形”或“日晕圈”状病变

解析：本题考查牙髓-牙周联合病变。慢性根尖周炎反复发作从牙周排脓而未得到彻底治疗者，最终使得牙周病变成立，此为真正的牙髓-牙周联合病变，有人称之为逆行性牙周炎，X线片表现为根尖区形成典型的“烧瓶形”或“日晕圈”状病变（D对），即阴影围绕根尖区并向牙槽嵴顶处逐渐变窄。也可有深牙周袋（A错）、牙槽骨吸收（B错）、牙周袋溢脓（C错）、牙松动（E错），但并不是逆行性牙周炎的典型特点，这些病变是慢性牙周炎或牙槽脓肿的一般临床特点。